女，17岁。脑部重伤入院，经各种治疗仍于3天后，患者进入脑死亡状态。现用呼吸机及各种设备维持生命这种情况下，医生应采取的措施是
A. 经全科讨论后撤掉呼吸机
B. 只要病人家属要求，一直维持这种状态
C. 私自决定撤掉呼吸机
D. 向父母解释脑死亡，征得同意撤掉呼吸机
E. 在卫生资源紧缺情况时，撤掉其呼吸机

正确答案：D。向父母解释脑死亡，征得同意撤掉呼吸机

解析：脑死亡作为比心肺死亡更为科学的死亡标准。脑死亡是脑细胞广泛、永久地丧失了全部功能，范围涉及大脑、小脑、桥脑和延髓。即发生全脑死亡后，虽心跳尚存，但脑复苏已不可能，个体死亡已经发生且不可避免。医生应向父母解释脑死亡，征得同意撤掉呼吸机（D对）。